李某，女，24岁。突发寒战高热，咳嗽咳痰，右胸痛3天，予退热剂后出现大汗淋漓，头晕，眼花，心悸，速来急诊。查体：神志清楚，血压70/45mmHg，心率130次/分，呼吸急促，口唇发绀，右下肺叩浊音，可闻及管状呼吸音。血象：白细胞25.6×10⁹/L，中性粒细胞0.86×10⁹/L。X线显示：右下肺大片炎症浸润阴影。治疗应首选的措施是
A. 针对病原菌选用有效抗生素
B. 畅通气道，祛痰，止咳，吸氧
C. 应用糖皮质激素
D. 纠正水电解质和酸碱紊乱
E. 补充血容量，纠正酸中毒，应用血管活性药物，纠正水电解质紊乱

正确答案：E。补充血容量，纠正酸中毒，应用血管活性药物，纠正水电解质紊乱

解析：青年女性，突发寒战高热，咳嗽咳痰，右胸痛3天（为肺炎的典型临床表现），予退热剂后出现大汗淋漓，头晕，眼花，心悸（为休克表现），查体：神志清楚，血压70/45mmHg，心率130次/分（血压降低，心率加快，显示患者为休克状态），呼吸急促，口唇发绀（提示缺氧），右下肺叩浊音，可闻及管状呼吸音（肺炎体征），辅助检查示：血白细胞25.6×10⁹/L，中性粒细胞0.86，X线示：右下肺大片炎症浸润阴影（血象为白细胞和中性粒细胞升高为主，结合X线表现，提示细菌性肺炎），结合患者的临床表现，体征及辅助检查，可确定患者为细菌性肺炎导致的感染性休克状态，应积极补充血容量，纠正酸中毒，应用血管活性药物，纠正水电解质紊乱（E对），光纠正水电解质紊乱和酸碱紊乱是不够的（D错）。针对病原菌选用有效抗生素应在肺炎的早期阶段今早进行，本题患者已并发感染性休克，应首选补充血容量，纠正酸中毒，应用血管活性药物，纠正水电解质紊乱（A错）。畅通气道，祛痰，止咳，吸氧不适用于感染性休克患者（B错）。糖皮质激素可用于减轻气道炎症，适用于哮喘患者，不适用于细菌性肺炎并发感染性休克患者（C错）。